下列各项，不是妊娠合并心脏病主要症状的是
A. 心悸
B. 腹痛
C. 浮肿
D. 气短
E. 乏力

正确答案：B。腹痛

解析：妊娠合并心脏病多见以心血管系统疾病症状，包括胸痛而非腹痛（B错，为本题正确答案）、心悸（A对）胸闷、劳力性呼吸困难（D对）、乏力（E对）…体征可见浮肿（C对）、紫绀…